男，50岁，某公司总经理。在公司某次业务培训会的开幕式上致辞后出现口误，宣布“会议闭幕”。此口误背后折射出该总经理的心理活动为
A. 潜意识
B. 前意识
C. 超我
D. 意识
E. 本我

正确答案：A。潜意识

解析：潜意识是指人的心理结构的深层，那些我们意识不到的，但却激发我们大多数的言语、情感和行为的原始冲动或本能欲望。潜意识的内容包括本能的能量和被压抑的欲望。题目中总经理的口误折射出的就是他的潜意识（A对）。前意识（B错）介于潜意识与意识之间。包括所有当时意识不到但在某些情况下可以意识到的那些心理要素，主要功能是起到警戒作用。意识（D错）是指那些在任何时刻都被知觉到的心理要素。本我、自我、超我是弗洛伊德在人格结构理论中提出的概念。超我（C错）是从自我发展出来的，是个体在成长过程中通过内化道德规范、社会及文化环境的价值观念而形成的。本我（E错）位于人格的核心，是人的心理经验中最原始的部分，是潜意识的，包括了性本能冲动和原始欲望。